教育部颁布的“学校体育工作条例”规定，中小学生每天体育锻炼的时间应该不低于
A. 30分钟
B. 45分钟
C. 1小时
D. 1.5小时
E. 2小时

正确答案：C。1小时